红细胞缺乏葡萄糖-6-磷酸脱氢酶的孕妇，临产期使用可引起新生儿溶血的药品是
A. 磺胺嘧啶
B. 氯霉素
C. 头孢氨苄
D. 青霉素
E. 替硝唑

正确答案：A。磺胺嘧啶

解析：本题考查妊娠期妇女用药。红细胞缺乏葡萄糖-6-磷酸脱氢酶的孕妇，临产期使用可引起新生儿溶血的药品是磺胺嘧啶（A对）。氯霉素（B错）可使产儿发生灰婴综合征。头孢氨苄（C错）不良反应为恶心、呕吐。青霉素（D错）不良反应为过敏反应。替硝唑（E错）不良反应少见并且轻微。